完全固定桥是指
A. 双端固定桥
B. 连接体均为固定连接的固定桥
C. 复合固定桥
D. 粘结固定桥
E. 完全固定的固定桥

正确答案：A。双端固定桥

解析：双端固定桥又称完全固定桥，两端均有固位体，且固位体与桥体之间为固定连接，并借固位体固定在基牙上。基牙、固位体、桥体称为一个整体，（牙合）力通过基牙传给牙周组织。双端固定桥与其他结构的固定桥相比，能承受的（牙合）力最大、患者感觉舒适，预后最佳，所以被临床广泛运用。掌握“固定桥的组成和分类”知识点。